6、7位具有含氧环结构的生物碱是
A. 药根碱
B. 次乌头碱
C. 东莨菪碱
D. 莨菪碱
E. 甲基伪麻黄碱

正确答案：C。东莨菪碱

解析：本题考查的是东莨菪碱的分子结构。6、7位具有含氧环结构的生物碱是东莨菪碱（C对）。东莨菪碱分子结构中氮原子附近较莨菪碱（D错）多一个6，7位环氧基，对氮原子产生显著的空间阻碍，其碱性较莨菪减弱。药根碱（A错）、次乌头碱（B错）、甲基伪麻黄碱（E错）分子内6，7位均具不含氧环结构。